依据《中华人民共和国价格法》，下列属于经营者正当价格行为的是
A. 相互串通，操纵市场价格，损害其他经营者或消费者的合法权益
B. 为了排挤竞争对手或者独占市场，以低于成本的价格倾捎
C. 降价处理鲜活商品、季节性商品、积压商品
D. 捏造、散布涨价信息，哄抬价洛，推动商品价格过高上涨
E. 提供相同商品或者服务，对具有同等交易条件的其他经营者实行价格歧视

正确答案：C。降价处理鲜活商品、季节性商品、积压商品